不符合肺心病胸部X线表现的是
A. 心尖上翘
B. 心脏向左下扩大、靴形
C. 肺动脉段扩张
D. 梨形心
E. 右下肺动脉增宽

正确答案：B。心脏向左下扩大、靴形

解析：肺心病胸部X线片可见右下肺动脉增宽（E对），肺动脉段扩张（C对）和心尖上翘（A对），肺动脉段扩张及心尖上翘，主动脉结节缩小或正常，状如梨形，成为梨形心（D对）。心脏向左下扩大、靴形（B错，为本题正确答案）临床常见于主动脉瓣关闭不全。